我国的《游泳场所卫生标准》对人工游泳池水质的以下项目作了具体规定，除了
A. pH
B. 浑浊度
C. 尿素
D. 溶解氧
E. 细菌学指标

正确答案：D。溶解氧

解析：本题考查我国《游泳场所卫生标准》对人工游泳池水质作了具体规定的项目。《游泳场所卫生标准》（GB 9668-1996）对人工游泳池水质的以下项目作了具体规定：包括pH（A对）应为6.5～8.5，浑浊度（B对）不应大于5度，尿素（C对）不得超过3.5mg/L，游离性余氯应为0.3～0. 5mg/L，细菌总数（E对）不应超过1000个/ml，总大肠菌群不应超过18个/L等，除了溶解氧（D错，为本题正确答案）。